猪苓汤组成中含有的药物是
A. 泽泻，丹参
B. 茯苓，牡丹皮
C. 阿胶，白术
D. 滑石，山药
E. 茯苓，滑石

正确答案：E。茯苓，滑石

解析：本题考查猪苓丸的组成，记忆即可。猪苓汤由猪苓、茯苓、泽泻、阿胶、滑石。方歌：猪苓汤内有茯苓，泽泻阿胶滑石并，小便不利兼烦渴，滋阴利水症自平。（E对）。